不属于阿昔洛韦适应证的是
A. 单纯疱疹
B. 带状疱疹
C. 免疫缺陷者水痘
D. 病毒性急性视网膜坏死
E. 乙型流感

正确答案：E。乙型流感

解析：本题考查阿昔洛韦的适应症。不属于阿昔洛韦适应证的是乙型流感（E错，为本题正确答案）。奥司他韦用于成人和1岁及1岁以上儿童的甲型和乙型流感治疗，用于成人和13岁及13岁以上青少年的甲型和乙型流感的预防。阿昔洛韦为一种合成的嘌呤核苷类似物，是核苷类抗病毒药，主要用于：①单纯疱疹（A对）病毒感染：用于免疫缺陷者初发和复发性黏膜皮肤感染的治疗以及反复发作病例的预防；也用于单纯疱疹性脑炎治疗。②带状疱疹（B对）：用于免疫缺陷者严重带状疱疹患者或免疫功能正常者弥散型带状疱疹的治疗。③免疫缺陷者水痘（C对）的治疗。④病毒性急性视网膜坏死（D对）的治疗。